男孩，8岁。上课反应迟钝，一般的学习任务难以完成。家长带其来心理门诊就诊。心理治疗师应该首先考虑使用的心理评估工具是
A. WISC
B. SDS
C. 16PF
D. EPQ
E. SAS

正确答案：A。WISC

解析：韦氏量表包括成人（16岁以上）、儿童（6 ~ 16岁）和学龄前期（4 ~ 6岁）三个年龄版本。.最早是Wechsler在1939年出版的W-B，先后几次发展和修订，现在成为“韦氏成人智力量表” （WAIS），其修订本为 WAIS-R）、“韦氏儿童智力量表”（WISC， 修订本为WISC-R）和“韦氏学前和初级小学儿童量表”（WPPSI）。题中儿童应首先选用智力量表进行评估，选用韦氏儿童智力量表（A对）。抑郁自评量表（SDS）能相当直观地反映病人抑郁的主观感受及严重程度（B错）。卡特尔16项人格因素问卷（16PF）测量个体的人格特征（C错）。艾森克人格问卷（EPQ）测量人格特征（D错）。焦虑自评量表（SAS）测量有无焦虑症状及其严重程度（E错）。